各种发育年龄中应用最广泛的是
A. 骨骼年龄
B. 牙齿年龄
C. 形态年龄
D. 第二性征年龄
E. 心理年龄

正确答案：A。骨骼年龄